根据2015版《中国药典》，按照麻醉药品管理的中药是
A. 罂粟壳
B. 麻黄
C. 大黄
D. 艾叶
E. 斑蝥

正确答案：A。罂粟壳

解析：本题考查的是部分毒性中药及按麻醉药管理的饮片调配。根据2015版《中国药典》，按照麻醉药品管理的中药是罂粟壳（A对）。部分毒性中药及按麻醉药管理的饮片调配：国务院1988年12月27日颁布《医疗毒性药品管理办法》中规定的毒性中药、国家中医药管理局2007年3月12日发布《医院中药饮片管理规范》中规定按麻醉药管理的饮片，属于特殊管理的中药饮片，对含这类饮片的处方有特殊的规定，调剂时应严格按照规定执行。毒性中药系指毒性剧烈，治疗剂量与中毒剂量相近，使用不当会致人中毒或死亡的中药。毒性中药品种有28种：砒石（红砒，白砒）、砒霜、水银、雄黄、轻粉、红粉、红升丹、白降丹、生川乌、生草乌、生白附子、生附子、生半夏、生南星、生狼毒、生甘遂、生藤黄、洋金花、闹羊花、雪上一枝蒿、斑蝥（E错）、青娘虫、红娘虫、蟾酥、生马钱子、生巴豆、生千金子、生天仙子。按麻醉药管理的饮片只有一味罂粟壳。1.毒性中药的用法用量及调配：毒性中药饮片是毒性中药材经过加工炮制后可直接用于中医临床的药品。毒性中药饮片的药性峻烈，如何掌握好毒性中药饮片的用法用量，安全合理用药显得尤为重要。为了加强对医疗用毒性药品的管理，保证用药安全，防止出现中毒和死亡的事故，药品经营企业和医疗单位在经营和使用毒性中药时必须遵守有关法规规定。含有28种毒性中药饮片的处方，每次处方剂量不得超过二日极量。如在审方时对处方有疑问，必须经处方医生重新审定后方可调配。处方保存两年备查。对处方未注明“生用”的，应给付炮制品，不属于毒性饮片处方。2.罂粟壳的用法用量及调配：罂粟壳也称米壳，其炮制规格有生罂粟壳和蜜罂粟壳，处方用名罂粟壳时给付蜜罂粟壳。罂粟壳具有敛肺止咳，涩肠，定痛的功效。治久咳，久泻，久痢，脱肛，便血，心腹筋骨诸痛，滑精，多尿，白带等病证，临床使用时的用量一般在3～6g。本品有成瘾性，故不宜常服，孕妇及儿童禁用，运动员慎用。罂粟壳必须凭有麻醉药处方权的执业医师签名的淡红色麻醉药处方方可调配，应于群药中，且与群药一起调配，不得单方发药，每张处方不得超过三日用量，连续使用不得超过7天，成人一次的常用量为每天3～6g。处方保存3年备查。麻黄（B错）与大黄（C错）不属于毒性中药。艾叶（D错）有小毒，用量3～9g。外用适量，供灸治或熏洗用。